医学道德评价的方式包括
A. 医德原则、医德规范、医德范畴
B. 医德原则、医德规范、内心信念
C. 社会舆论、传统习俗、医德范畴
D. 社会舆论、传统习俗、内心信念
E. 社会舆论、医德原则、内心信念

正确答案：D。社会舆论、传统习俗、内心信念